反密码子UAG识别的mRNA上的密码子是
A. GTC
B. ATC
C. AUC
D. CUA
E. CTA

正确答案：D。CUA

解析：RNA的碱基组成为A、U、C、G，不包括T（ABE错）。tRNA的反密码子利用碱基互补的方式辨认mRNA的密码子，A与U配对，C与G配对，因此tRNA中反密码子5＇-UAG-3＇对应mRNA上为3＇-AUC-5＇，同时我们要注意核酸分子具有5＇→3＇的方向性，核苷酸的排列顺序和书写规则都是从5＇-端到3＇-端，即为CUA（D对）。